有机磷农药中毒的毒蕈碱样症状，下列哪一项是错误的
A. 食欲减退
B. 腹痛腹泻
C. 多汗、流涎
D. 瞳孔缩小
E. 瞳孔放大

正确答案：E。瞳孔放大